髌骨的描述中，错误的是
A. 是全身最大的籽骨
B. 位于股四头肌腱内
C. 髌骨上宽下窄
D. 前面光滑，后面粗糙
E. 可于体表摸到

正确答案：D。前面光滑，后面粗糙

解析：髌骨是人体最大的籽骨（A对），位于股骨下端前面、股四头肌腱内（B对），上宽下尖（C对），前面粗糙（D错，为本题正确答案），后面为关节面，髌骨可在体表扪及（E对）。